引起猩红热皮疹的物质主要是
A. M蛋白
B. 红疹毒素
C. 链激酶
D. 脂磷壁酸
E. 透明质酸酶

正确答案：B。红疹毒素